《处方管理办法》规定，门诊对重度慢性疼痛患者开具的麻醉药品控缓释制剂，每张处方不得超过
A. 1日常用量
B. 3日常用量
C. 5日常用量
D. 7日常用量
E. 15日常用量

正确答案：E。15日常用量

解析：本题考查的是处方限量。《处方管理办法》规定，门诊对重度慢性疼痛患者开具的麻醉药品控缓释制剂，每张处方不得超过15日常用量（E对）。处方限量：处方一般不得超过7日用量（D错）；急诊处方一般不得超过3日用量（B错）；对于某些慢性病、老年病或特殊情况，处方用量可适当延长，但医师应当注明理由。麻醉药品、精神药品、医疗用毒性药品、放射性药品的处方用量应当严格按照国家有关规定执行。为门（急）诊一般患者开具的麻醉药品注射剂，每张处方为一次常用量；控缓释制剂，每张处方不得超过7日常用量；其他剂型，每张处方不得超过3日常用量。第一类精神药品处方限量同麻醉药品；哌醋甲酯用于治疗儿童多动症时，每张处方不得超过15日常用量。第二类精神药品一般每张处方不得超过7日常用量；对于慢性病或某些特殊情况的患者，处方用量可以适当延长，医师应当注明理由。为门（急）诊癌症疼痛患者和中、重度慢性疼痛患者开具的麻醉药品、第一类精神药品注射剂，每张处方不得超过3日常用量；控缓释制剂，每张处方不得超过15日常用量；其他剂型，每张处方不得超过7日常用量。为住院患者开具的麻醉药品和第一类精神药品处方应当逐日开具，每张处方为1日常用量（A错）。对于需要特别加强管制的麻醉药品，盐酸二氢埃托啡处方为一次常用量，仅限于二级以上医院内使用；盐酸哌替啶处方为一次常用量，仅限于医疗机构内使用。